源于桔梗科，能清肺养阴、祛痰的药是
A. 黄精
B. 玉竹
C. 百合
D. 北沙参
E. 南沙参

正确答案：E。南沙参

解析：本题考查南沙参的来源和功效。源于桔梗科，能清肺养阴、祛痰的药是南沙参（E错）。南沙参【来源】桔梗科植物轮叶沙参或沙参的新鲜或干燥根。新鲜者名鲜沙参。【功效】清肺养阴，祛痰，益气。黄精（A错）【来源】百合科植物滇黄精、黄精或多花黄精的干燥根茎。【功效】滋阴润肺，补脾益气。玉竹（B错）【来源】百合科植物玉竹的干燥根茎。【功效】滋阴润肺，生津养胃。百合（C错）【来源】百合科植物卷丹、百合或细叶百合的干燥肉质鳞叶。【功效】养阴润肺，清心安神。北沙参（D错）【来源】伞形科植物珊瑚菜的干燥根。【功效】养阴清肺，益胃生津。